发病率的定义是
A. 一定时期内发生某病新旧病例的频率
B. 一定时期内发生某病新病例的频率
C. 一定时期内发生某病的频率
D. 一定时期内所有患病人数占总人数的比例
E. 以上都不对

正确答案：B。一定时期内发生某病新病例的频率